清热养肝，明目退翳的药是
A. 夏枯草
B. 密蒙花
C. 谷精草
D. 青葙子
E. 决明子

正确答案：B。密蒙花

解析：本题考查的是密蒙花的功效。清热养肝，明目退翳的药是密蒙花（B对）。密蒙花：【功效】清热养肝，明目退翳。夏枯草（A错）：【功效】清肝明目，散结消肿。谷精草（C错）：【功效】疏散风热，明目退翳。青葙子（D错）：【功效】清肝泻火，明目退翳。决明子（E错）：【功效】清肝明目，润肠通便。